以下不是口腔颌面部腔窦的是
A. 口腔
B. 鼻腔
C. 鼻窦
D. 眼眶
E. 骨髓腔

正确答案：E。骨髓腔

解析：本题考查口腔颌面部创伤概论。骨髓腔（E错，为本题正确答案）不是口腔颌面部腔窦。口腔颌面部腔窦多，有口腔（A对）、鼻腔（B对）、鼻窦（C对）及眼眶（D对）等。